关于妊娠合并心脏病叙述哪项不对
A. 妊娠合并心脏病是孕产妇死亡的主要原因之一
B. 妊娠32～34周血容量增加达高峰
C. 分娩第二期比第一期心脏负担重
D. 分娩第三期心脏负担仍很重
E. 产后2～3天心脏负担减轻

正确答案：E。产后2～3天心脏负担减轻

解析：本题考查妊娠合并心脏病。产后3内仍是心脏负担较重的时期（E错，为本题的正确答案）。妊娠期、分娩期及产褥期均可能使心脏病患者的心脏负担加重而诱发心力衰竭，妊娠合并心脏病是孕产妇死亡的主要原因之一（A对）。孕妇的总血容量较非妊娠期增加，一般自妊娠第6周开始，妊娠32～34周血容量增加达高峰（B对）。第二产程时由于孕妇屏气，先天性心脏病孕妇有时可因肺循环压力增加，使原来左向右分流转为右向左分流而出现发绀，故分娩第二期比第一期心脏负担重（C对）。胎儿胎盘娩出后，子宫突然缩小，胎盘循环停止，回心血量增加。另外，腹腔内压骤减，大量血液向内脏灌注，造成血流动力学急剧变化此时患心脏病孕妇极易发生心力衰竭，故分娩第三期心脏负担仍很重（D对）。